心肌从兴奋的电活动转为收缩的机械活动的关键点是
A. 肌浆网Ca²⁺摄取能力
B. 肌浆网Ca²⁺储存量
C. 肌浆网Ca²⁺释放量
D. 胞外Ca²⁺内流
E. 肌钙蛋白与Ca²⁺结合

正确答案：E。肌钙蛋白与Ca²⁺结合

解析：心肌细胞兴奋时，细胞外Ca2+进入细胞，并激活肌浆网内储存的Ca2+释放，而后胞质内的Ca2+和肌钙蛋白结合，并发生后续一系列变化，最终引发心肌收缩。因而心肌兴奋－收缩耦联的关键在于胞质内的Ca2+和肌钙蛋白结合（E对）。